乙肝病毒可以通过以下几种途径在口腔临床中进行传播，除外的是
A. 血液
B. 唾液
C. 龈沟液
D. 接触被污染的环境
E. 牙齿

正确答案：E。牙齿

解析：乙肝病毒在口腔临床中的传播方式主要是接触传播，通过直接接触患者的血液、唾液、龈沟液以及接触被污染的环境都可能感染疾病。掌握“口腔医疗保健中的感染”知识点。